软脊膜
A. 薄而富含血管
B. 贴在蛛网膜的外表面
C. 与脑的软膜不相延续
D. 其内面有脑脊液
E. 越过脊髓的沟裂

正确答案：A。薄而富含血管

解析：脊髓的被膜由外向内为硬脊膜、脊髓蛛网膜和软脊膜。软脊膜薄而富含血管（A对），紧贴脊髓表面，并且是在在蛛网膜的内表面（B错）且与蛛网膜之间有较宽阔的间隙。脑脊液(CSF)是充满脑室系统、蛛网膜下隙（蛛网膜与软脊膜之间）（D错）和脊髓中央管内的无色透明液体。